从形态学角度取得毒效应的证据为
A. 食物利用率
B. 脏器系数
C. 病理学检查
D. 一般性指标
E. 特异性指标

正确答案：C。病理学检查